下列检查结果中，对诊断痰菌阴性肺结核意义最大的是
A. PPD试验阳性
B. 典型的胸部X线表现
C. 血结核抗体阳性
D. 痰结核杆菌PCR阳性
E. 血ADA（腺苷脱氨酶）水平增高

正确答案：B。典型的胸部X线表现

解析：根据菌阴肺结核诊断标准可知，ABCD均为其诊断要点，但根据第九版内科学教材，可知对其诊断意义最大的是典型的结核临床症状和胸部X线表现（B对）。PPD试验阳性（A错）用于结核分枝杆菌的感染，而非检出结核病，但由于卡介苗的广泛接种，而结合菌素试验不能区分是自然感染还是接种卡介苗的免疫反应，所以检出率受到了限制。血结核抗体阳性（C错）只能检出受过结核杆菌的感染。痰结核杆菌PCR阳性（D错）容易受外界的污染，此种方法尚需改进和完善。血ADA（腺苷脱氧酶）（P116）（E错）在淋巴细胞内含量较高，结核病时，细胞免疫受刺激，淋巴细胞明显增多，故ADA增高，但是HIV合并结核患者ADA并不升高。